能形成较稳定的分子内氢键
A. 麻黄碱
B. 伪麻黄碱
C. 二者均是
D. 二者均不是

正确答案：B。伪麻黄碱